下列哪项不是输血的适应证
A. 严重感染
B. 大面积烧伤
C. 心力衰竭
D. 凝血功能异常
E. 低蛋白血症

正确答案：C。心力衰竭

解析：外科输血的目的有两个方面，一是纠正低血容量，二是纠正血液成分的缺乏，外科输血的适应证都是由此而来。输血的适应症：1.重症感染（A对）2.凝血异常（D对）3.贫血或低蛋白血症（E对）4.急性大量出血。而大面积烧伤后最初数小时或十多个小时，由于受伤局部有大量血浆液自毛细血管渗出至创面和组织间隙，造成有效循环血量减少，属于低血容量性休克，所以也是输血的适应证（B对）。本题问的是哪项不是输血的适应证，故选心力衰竭（C错，为本题正确答案）。